龟鹿补肾丸具有补肾壮阳、益气血、壮筋骨的功能。处方组成：盐菟丝子51g、淫羊藿（蒸）43g、续断（盐蒸）43g、锁阳（蒸）51g、狗脊（盐蒸）64g、酸枣仁（炒）43g、制何首乌64g、炙甘草21g、陈皮（蒸）21g、鹿角胶（炒）9g、熟地黄64g、龟甲胶（炒）13g、金樱子（蒸）51g、炙黄芪43g、山药（炒）43g、覆盆子（蒸）85g。以上十六味，粉碎成细粉，过筛，混匀，每100g粉末加炼蜜40g，加适量水泛丸，干燥，制成水蜜丸；或加炼蜜100～110g制成大蜜丸，即得。关于处方中炙甘草的说法，错误的是
A. 甘草味平，生品偏凉，蜜炙后偏温
B. 甘草蜜炙后补脾和胃、益气复脉力胜
C. 甘草蜜炙后止痛作用增强
D. 蜜炙甘草时，每100kg甘草片用熟蜜20kg
E. 蜜炙甘草时，在净甘草片中加入适量开水稀释的熟蜜，拌匀，闷润，文火炒至黄色至深黄色、不沾手时，取出晾凉

正确答案：D。蜜炙甘草时，每100kg甘草片用熟蜜20kg

解析：本题考查甘草的炮制方法和炮制作用。关于处方中炙甘草炮制方法和作用的说法，错误的是蜜炙甘草时，每100kg甘草片用熟蜜20kg（D错，为本题正确答案）。甘草【炮制方法】处方用名有甘草、粉甘草、炙甘草、蜜甘草。①甘草：取原药材，除去杂质，洗净，润透，切厚片，干燥。②炙甘草：取熟蜜，加适量开水稀释后，淋入净甘草片中拌匀，闷润，置炒制容器内，文火加热，炒至黄色至深黄色、不粘手时，取出晾凉（E对）。每100kg甘草片，用熟蜜25kg。【炮制作用】甘草味甘，性平归心、肺、胃经。具有补脾益气，清热解毒，祛痰止咳，缓急止痛，调和诸药的功能。①生品味甘偏凉，长于泻火解毒，化痰止咳。多用于痰热咳嗽，咽喉肿痛，痈疽疮毒，食物中毒及药物中毒。②炙甘草甘温（A对），以补脾和胃、益气复脉力胜（B对）。常用于脾胃虚弱，心气不足，脘腹疼痛，筋脉挛急，脉结代。甘草蜜炙前后的甘草苷、甘草酸的含量无明显变化，炮制温度越高则甘草酸含量下降越多。炙甘草能抗多种心律失常，作用优于生甘草。蜜炙还能增强甘草止痛效果（C对）。